关于侧压根管充填法不正确的是
A. 主尖应充满根尖并于根尖孔平齐
B. 主尖尖端应位于根管狭窄处
C. 副尖可不必到达根尖
D. 副尖可根据情况放入不同的根数
E. 临床上多数情况下，放入主尖后还需要插入副尖

正确答案：A。主尖应充满根尖并于根尖孔平齐

解析：本题考查根管充填。关于侧压根管充填法不正确的是主尖应充满根尖并于根尖孔平齐（A错，为本题正确答案）。主尖尖端应位于根管狭窄处，根管在接近根尖时有一个狭窄的部位，距离解剖性根尖孔约0.5～2mm。除解剖性根尖孔，根管在接近根尖时有一个狭窄的部位，这就是牙本质牙骨质界，即生理性根尖孔，距离解剖性根尖孔约0.5～2mm。这个部位就是髓腔预备的终止点，也是根管充填的终止点。此处亦称根尖基点，或称根尖止点。生理性根尖孔就是根尖狭窄。解剖性根尖孔是根管在牙根表面的开口，就是牙根从表面看的最顶端。